扶正法适用于
A. 实证
B. 虚证
C. 虚中夹实
D. 虚实夹杂
E. 实中夹虚

正确答案：B。虚证

解析：扶正，一般多用于某些慢性疾病，或疾病后期、恢复期，或素体虚弱之人（B对）；实证采取祛邪的治则（A错）；虚中夹实采取以扶正为主，佐以祛邪的治则（C错）；虚实夹杂采取扶正、祛邪先后使用的治则（D错）；实中夹虚采取以祛邪为主，佐以扶正的治则（E错）。